治疗药物监测的目的是保证药物治疗的有效性和安全性，在血药浓度-效应关系已经确立的前提下，需要进行血药浓度监测的有
A. 治疗指数小，毒性反应大的药物
B. 具有线性动力学特征的药物
C. 在体内容易蓄积而发生毒性反应的药物
D. 合并用药易出现异常反应的药物
E. 个体差异很大的药物

正确答案：A、C、D、E。治疗指数小，毒性反应大的药物；在体内容易蓄积而发生毒性反应的药物；合并用药易出现异常反应的药物；个体差异很大的药物

解析：本题考查血药浓度监测。需要进行血药浓度监测的有：治疗指数小，毒性反应强的药物（A对）；具有非线性药代动力学特性的药物（B错）；长期用药，血药浓度可受各种因素的影响而发生变化，有的可在体内逐渐蓄积而发生毒性反应（C对）；合并用药而出现异常反应的药物（D对）；个体差异很大的药物（E对）。